二妙散的功用
A. 清热利水
B. 清热燥湿
C. 清热养阴
D. 利湿消肿
E. 解毒化湿

正确答案：B。清热燥湿

解析：二妙散功效为清热燥湿（B对），方中黄柏寒凉苦燥，其性沉降，善清下焦湿热，苍术辛苦而温，一则健脾助运以治生湿之本，二则芳华苦燥以除湿阻之标，为治疗湿热下注之痿痹、脚气、带下、湿疮等病症的基础方。